既清肝明目，又润肠通便的药是
A. 决明子
B. 火麻仁
C. 蔓荆子
D. 青葙子
E. 冬葵子

正确答案：A。决明子

解析：本题考查的是决明子的功效。既清肝明目，又润肠通便的药是决明子（A对）。决明子：【功效】清肝明目，润肠通便。火麻仁（B错）：【功效】润肠通便。蔓荆子（C错）：【功效】疏散风热，清利头目，祛风止痛。青葙子（D错）：【功效】清肝泻火，明目退翳。冬葵子（E错）：【功效】利水通淋，下乳，润肠通便。